静脉注射去甲肾上腺素后出现血压升高，心率减慢。心率减慢出现的主要原因是
A. 去甲肾上腺素对心脏的抑制作用
B. 去甲肾上腺素对血管的抑制作用
C. 减压反射活动减弱
D. 减压反射活动增强
E. 大脑皮质心血管活动中枢活动减弱

正确答案：D。减压反射活动增强